与大气压力作用无关的是
A. 基托与黏膜的接触面积
B. 基托与黏膜的密合度
C. 义齿边缘封闭效果
D. （牙合）力大小
E. 以上都对

正确答案：D。（牙合）力大小

解析：当义齿受到脱位力的作用时，如果基托边沿与黏膜密合，周围软组织将基托边缘包裹严密，空气不能进入基托与黏膜之间，就会在基托与黏膜之间形成负压，此时由于大气压力的作用，就会使义齿基托与黏膜贴合而不至于脱位。大气压力是使义齿固位的重要固位力。而义齿基托边缘与周围组织的密合即边缘封闭是获得大气压力固位的前提条件，基托边缘封闭越好，则大气压力的作用越强，义齿的固位力也越大。而（牙合）力大小与其无关。掌握“全口义齿固位及稳定”知识点。